某男，75岁，患中风1年，左侧肢软无力，手足浮肿，语言謇涩，面色少华。舌体不正，舌质淡紫，边有痧斑，舌苔薄白，脉细涩无力。中医辨证是
A. 风痰阻络
B. 气虚血瘀
C. 肾精亏损
D. 痰蒙神窍
E. 肝阳上亢

正确答案：B。气虚血瘀

解析：本题考查的是中风的辨证论治。患中风1年，左侧肢软无力，手足浮肿，语言謇涩，面色少华。舌体不正，舌质淡紫，边有痧斑，舌苔薄白，脉细涩无力。中医辨证是气虚血瘀（B对）。中风是以猝然昏仆，不省人事，半身不遂，口眼㖞斜，语言不利为主症的疾病。病轻者可无昏仆而仅见半身不遂和口眼㖞斜等症状。西医学的急性脑血管疾病，如脑梗死、脑出血、短暂性脑缺血发作和蛛网膜下腔出血等有上述表现者，可参考此内容辨证论治。（一）风痰入络（A错）证：【症状】肌肤不仁，手足麻木，突然发生口眼斜，语言不利，口角流涎，舌强语謇，甚则半身不遂，或兼见手足拘挛，关节酸痛等症。舌苔薄白，脉浮数。（二）风阳上扰证：【症状】平素头晕头痛，耳鸣目眩，突然发生口眼斜，舌强语謇，或手足重滞，甚则半身不遂。舌质红苔黄，脉弦。（三）气虚血瘀证：【症状】肢体偏枯不用，肢软无力，面色萎黄。舌质淡紫或有瘀斑，苔薄白，脉细涩或细弱。肾精亏损（C错）为耳鸣耳聋的辨证。耳鸣耳聋肾精亏损证：【症状】耳鸣或耳聋久发，耳鸣如蝉，昼夜不息，安静时尤甚，听力逐渐下降，伴有腰膝酸软，头晕目眩，或虚烦失眠，夜尿频多。舌淡红，少苔，脉细弱。肝阳上亢（E错）为眩晕的辨证。眩晕肝阳上亢证：【症状】眩晕，耳鸣，头目胀痛，口苦，失眠多梦，遇烦劳郁怒而加重，颜面潮红，急躁易怒。舌红苔黄，脉弦或数。辨证为痰蒙神窍（D错）的疾病，2022年考试指南未明确说明。